津亏血燥便秘的主要症状是
A. 大便干结，小便短赤，口苦，舌红
B. 大便秘结，欲便不得，嗳气，苔腻
C. 大便秘结，面色无华，心悸，舌淡
D. 大便艰涩，面色淡白，腹冷，舌淡
E. 大便干燥，纳食减少，嗳气，舌淡

正确答案：C。大便秘结，面色无华，心悸，舌淡

解析：本题考查的是便秘的辨证论治。津亏血燥便秘的主要症状是大便秘结，面色无华，心悸，舌淡（C对）。便秘是指粪便在肠内滞留过久，秘结不通，排便周期延长，或周期不长，但粪质干结，排出艰难，或粪质不硬，虽有便意，但排而不畅的疾病。西医学的功能性便秘、肠易激综合征、直肠肛门疾患引起的便秘、药物性便秘等，可参考此内容辨证论治。（一）虚秘【症状】大便并不干硬，虽有便意，但排便困难，用力努挣则汗出短气，便后乏力，面白神疲，肢倦懒言。舌淡苔白，脉弱。（二）热秘【症状】大便干结，腹胀腹痛，口干口臭，面红心烦，或有身热，小便短赤。舌红（A错），苔黄燥，脉滑数。（三）气秘【症状】大便干结，或不甚干结，欲便不得出，或便出不爽，胸胁痞满，肠鸣矢气，腹中胀痛，嗳气频作，纳食减少。舌苔薄腻（B错），脉弦。（四）冷秘【症状】大便艰涩（D错），腹痛拘急，胀满拒按，胁下偏痛，手足不温，呃逆呕吐。舌苔白腻，脉弦紧。